服用抗痛风药别嘌醇时
A. 宜饮酒
B. 宜多饮水
C. 忌喝茶
D. 禁吸烟
E. 宜多食脂肪餐

正确答案：B。宜多饮水

解析：本题考查服用药物的特殊提示。服用抗痛风药别嘌醇时宜多饮水（B对）。服用抗痛风药别嘌醇时多饮水，是为了防止尿酸在排出过程中在泌尿系统沉积形成结石，同时应该碱化尿液，以利于排酸。服用别嘌醇时饮酒（A错），喝茶（C错），吸烟（D错），食用脂肪餐（E错）无影响。